下列关于样本含量估计的叙述，正确的是
A. 样本含量越大越好
B. 以实际可以收集到的样本含量为准
C. 时间、财力、人力等条件允许下的最大观察单位数
D. 一定的检验水准和检验效能下的最少观察单位数
E. 根据研究目的确定的最大观察单位数

正确答案：D。一定的检验水准和检验效能下的最少观察单位数